病人外阴瘙痒1周，查阴道粘膜覆以膜状物，擦除后露出红肿粘膜面，正确的处理应是
A. 局部用克林霉素软膏
B. 阴道内放置达克宁栓
C. 阴道内放置甲硝唑片
D. 阴道内放置尼尔雌醇片
E. 外阴部用0.5%醋酸液洗涤

正确答案：B。阴道内放置达克宁栓

解析：该病人外阴瘙痒，妇科检查阴道黏膜覆以膜状物（真菌感染的分泌物），擦除后露出红肿黏膜面（阴道黏膜红肿），首先考虑外阴阴道假丝酵母菌病，治疗主要采用局部短疗程抗真菌药物，如阴道内放置达克宁栓（为咪康唑栓剂商品名）（B对）。局部用克林霉素软膏（P252）（A错）、阴道内放置甲硝唑片（C错）都用于细菌性阴道病的治疗，口服甲硝唑片用于滴虫性阴道炎（P248）。阴道内放置尼尔雌醇片（P252）（D错）用于雌激素缺乏引起的萎缩性阴道炎。外阴部用0.5%醋酸液洗涤（P104）（E错）用于治疗尖锐湿疣。